一次性给动物注射毒物，经过3个生物半减期后，该毒物在动物体内的蓄积量为
A. 0.875
B. 0.5
C. 0.125
D. 0.0625
E. 0.035

正确答案：C。0.125

解析：本题考查毒物的蓄积量。生物半减期是指某种物质在生物体内经过一段时间后，其含量减少到原来的一半。因此，当某种物质在生物体内经过3个生物半减期后，其含量将减少到原来的1/8，即0.125（C对ABDE错）。